足月儿生后1小时后呼吸频率约是
A. 110次/分
B. 90次/分
C. 70次/分
D. 50次/分
E. 30次/分

正确答案：D。50次/分

解析：胎儿出生后肺发育尚不成熟，胸廓上的肋间肌肉也很薄弱，辅助呼吸的力度不够，但是新生儿的新陈代谢很旺盛，需氧量特别多，为了满足新生儿自身对氧的需要，新生儿依靠浅快的呼吸来满足氧的供给，因此新生儿呼吸频率较大。足月儿生后第1小时内呼吸频率可达60～80次／分（C错），1小时后呼吸频率降至40～50次／分（D对），以后维持在40次／分左右。